有机磷农药中毒的发病机制主要是有机磷抑制了
A. 胆碱酯酶
B. 6-磷酸葡萄糖脱氢酶
C. 细胞色素氧化酶
D. 糜蛋白酶
E. 乳酸脱氢酶

正确答案：A。胆碱酯酶

解析：有机磷农药中毒的发病机制主要为抑制胆碱酯酶（ChE）（A对），使乙酰胆碱不能被分解，持续发挥作用，引起如瞳孔缩小、腹痛、腹泻及多汗、呼吸困难等一系列毒蕈碱样症状及肌肉纤颤、肌痉挛等烟碱样症状。6-磷酸葡萄糖脱氢酶（B错）缺乏或受抑制见于蚕豆病。细胞色素氧化酶（C错）受抑制见于氰化物中毒。糜蛋白酶（D错）、乳酸脱氢酶（E错）与中毒无关。